苦味的作用特点是
A. 能软、能下
B. 能燥、能泄
C. 能补、能缓
D. 能收、能涩
E. 能散、能行

正确答案：B。能燥、能泄

解析：本题考查的是五味对人体的效果。苦味的作用特点是能泄、能燥（B对）。五味对人体的效果：（1）辛：能散、能行（E错），有发散、行气、活血作用。（2）甘：能补、能缓（C错）、能和，有补虚、和中、缓急、调和药性等作用。（3）酸：能收、能涩（D错），有收敛固涩作用。另外，酸能生津、安蛔。（4）苦：能泄、能燥、能坚。（5）咸：能软、能下（A错），有软坚散结、泻下通便作用。（6）涩：能收、能敛，同酸味一样有收敛固涩作用。（7）淡：能渗、能利，有渗湿利水作用。常将淡附于甘。此外，还有芳香味，其能散、能行、能开，有化湿、辟秽、开窍、醒脾等作用。